PCR变性温度一般为
A. 96℃
B. 85℃
C. 72℃
D. 62℃
E. 55℃

正确答案：A。96℃